女，22岁。受凉后出现寒战、发热，咳嗽，咳少许黏痰3天，自服“感冒药”后热退，查体：T39.5℃，急性病容，右肺呼吸音减弱，语音震颤增强，血WBC13.4×10⁹/L，N0.87。胸部X线片显示右下肺大片状模糊阴影。该患者抗感染治疗不宜首选的是
A. 青霉素
B. 左氧氟沙星
C. 阿莫西林
D. 头孢曲松
E. 阿米卡星

正确答案：E。阿米卡星

解析：患者为青年女性（为肺炎链球菌的好发年龄），寒颤、发热、咳嗽、咳少许黏痰，右肺呼吸音减弱，语音震颤增强（为肺炎链球菌肺炎的典型症状和体征），胸部X线片显示右下肺大片状模糊阴影，白细胞增高，根据其临床表现和辅助检查，该患者考虑为肺炎链球菌肺炎。青霉素、左氧氟沙星、阿莫西林、头孢曲松均可以用于肺炎链球菌治疗（ABCD对）。阿米卡星属于氨基糖苷类抗生素，临床主要用于对庆大霉素，卡那霉素耐药的革兰阴性杆菌如大肠杆菌、变形杆菌和绿脓杆菌引起的各种感染，如败血症、细菌性心内膜炎等，对革兰阳性球菌不敏感（肺炎链球菌为革兰阳性球菌）（E错，为本题正确答案）。